牙周炎时，可形成金属蛋白酶的细胞不包括
A. 中性粒细胞
B. 破骨细胞
C. 成纤维细胞
D. 上皮细胞
E. 巨噬细胞

正确答案：B。破骨细胞

解析：本题考查基质金属蛋白酶。牙周炎时，可形成金属蛋白酶的细胞不包括破骨细胞（B错，为本题的正确答案）。破骨细胞不能形成金属蛋白酶，具有特殊的吸收功能，造成骨的吸收。牙周炎时，可形成金属蛋白酶的细胞有中性粒细胞（A对）、成纤维细胞（C对）、上皮细胞（D对）以及被激活的巨噬细胞（E对），它们与牙周组织的重建息息相关，既可直接破坏、降解胶原，还可通过产生细胞因子增进结缔组织的降解。